太阳穴的定位是
A. 眉梢与目外眦之间，向后约1横指的凹陷处
B. 眉梢与目外眦之间，向后约2横指的凹陷处
C. 目外毗向后约2横指
D. 目外眦向后约1横指
E. 目正视，瞳孔直上，眉上1寸

正确答案：A。眉梢与目外眦之间，向后约1横指的凹陷处

解析：太阳穴属于奇穴，在当眉梢与目外毗之间，向后约一横指的凹陷中（A对），主治头痛、目疾、面瘫，宜直刺或斜刺0.3-0.5寸；或点刺出血。